患者，男，63岁、BMI28.73kg/m²，既往患有高血压、2型糖尿病、高脂血症。目前使用硝苯地平控释片、盐酸二甲双胍片、阿卡波糖片、瑞舒伐他汀钙片。因间断胸前区压榨性疼痛3个月住院，查体：血压165/93mmHg，心率70次/分，冠脉造影显示：冠状动脉左前降支狭窄50%，新诊断冠心病，给予阿司匹林肠溶片，单硝酸异山梨酯缓释片治疗。该患者入院后查空腹血糖8.3mmol/L，糖化血红蛋白8.5%，加用利拉鲁肽注射液。关于该药的说法，错误的是
A. 能以葡萄糖浓度依赖的方式，增加胰岛素的合成和分泌
B. 可增加饱腹感、延缓胃排空
C. 主要不良反应是胃肠道反应，如恶心、呕吐和腹泻
D. 皮下注射给药，一日2次，早晚餐前30分钟给药
E. 能在降低血糖的同时，有利于减轻体重

正确答案：D。皮下注射给药，一日2次，早晚餐前30分钟给药

解析：本题考查利拉鲁肽。利拉鲁肽仅用于皮下注射，一日1次，可在日间任意时间注射，注射时间与进食无关，但应维持每日用药时间恒定（D错，为本题正确答案）。